蓼大青叶的气孔轴式多为
A. 不等式
B. 不定式
C. 直轴式
D. 平轴式
E. 环式

正确答案：D。平轴式